免疫对机体
A. 是有益的反应
B. 是有害的反应
C. 有益也有害的反应
D. 无益也无害的反应
E. 正常情况下，对机体有益，在一定条件下有害

正确答案：E。正常情况下，对机体有益，在一定条件下有害